卡介苗接种后2～3个月结核菌素试验阳性率可达90%以上，一般可维持
A. 2～3年
B. 3～5年
C. 4～6年
D. 5～10年
E. 10～15年

正确答案：D。5～10年